经批准，普通商业企业连锁超市可销售的是
A. 一类精神药品
B. 处方药
C. 非处方药
D. 甲类非处方药
E. 乙类非处方药

正确答案：E。乙类非处方药

解析：本题考查处方药。经批准，普通商业企业连锁超市可销售的是乙类非处方药（E对）。零售药店不得经营的九大类药品：麻醉药品、放射性药品、一类精神药品（A错）、终止妊娠药品、蛋白同化制剂、肽类激素（胰岛素除外）、药品类易制毒化学品、疫苗、以及我国法律法规规定的其他药品零售企业不得经营的药品。处方药（B错）必须凭执业医师或执业助理医师处方销售购买和使用，不得采用开架自选销售的方式。非处方药（C错）包括甲类处方药和乙类处方药，甲类处方药不可在超市销售，因此非处方药答案不完全正确（C错）。